在身体健康的基础上生命质量更注重
A. 期望寿命
B. 个体生存能力
C. 个体的经济状况
D. 健康教育
E. 医疗卫生服务

正确答案：B。个体生存能力

解析：本题考查生命质量在身体健康的基础上更注重的内容。生命质量在身体健康的基础上更注重个体生存能力（B对ACDE错）。